能够促使人们维护和提高他们自身健康的过程的是
A. 健康教育
B. 健康调查
C. 健康宣讲
D. 健康促进
E. 疾病预防

正确答案：D。健康促进

解析：健康促进是指促使人们维护和提高他们自身健康的过程。掌握“干预基本模式及烟草行为干预”知识点。